适合于药物过敏试验的给药途径是
A. 静脉滴注
B. 肌内注射
C. 皮内注射
D. 皮下注射
E. 脊椎腔注射

正确答案：C。皮内注射

解析：本题考查注射给药的给药部位和吸收途径。皮内注射（C对）是将药物注射到真皮中，用于诊断与试敏试验；静脉滴注（A错）药物直接进入血液循环，无吸收过程；肌内注射（B错）药物经结缔组织扩散，再由毛细血管和淋巴吸收进入血液循环；皮下注射（D错）的吸收较慢，需延长作用时间的药物可采用皮下注射；脊椎腔注射（E错）是将药物直接注入脊椎腔内；以上四种均不能用于药物的过敏试验。